21岁，停经2个月，2天前在外自行堕胎，体温38.8℃.，脉搏130次/分，血压正常，白细胞10×109/L，中性0.90，子宫如孕2个月大小，软，有压痛，经抗炎治疗，感染未能控制，突然大量阴道出血，下列哪项处理为宜
A. 催产素肌肉注射
B. 卵圆钳轻取胚胎，术后应用抗生素
C. 抗生素及催产素
D. 即刻刮宫除去病灶
E. 抗生素及止血药物

正确答案：B。卵圆钳轻取胚胎，术后应用抗生素

解析：本例患者突然大流血考虑应该是不全流产导致的，所以，应该还有残留的胚胎或者组织，所以，需要卵圆钳轻取胚胎，术后应用抗生素抗感染。切不可用刮匙全面搔刮宫腔，以免造成感染扩散。掌握“自然流产”知识点。